洋地黄毒糖是
A. 6-去氧糖
B. 2，6-二去氧糖
C. 6-去氧糖甲醚
D. α-氨基糖
E. α-羟基糖

正确答案：B。2，6-二去氧糖

解析：本题考查的是强心苷中糖部分的结构特征。洋地黄毒糖是2，6-二去氧糖（B对）。构成强心苷的糖有20多种。根据它们C-2位上有无羟基可以分成α-羟基糖（2-羟基糖）和α-去氧糖（2-去氧糖）两类。α-去氧糖常见于强心苷类，是区别于其他苷类成分的一个重要特征。①α-羟基糖（E错）：组成强心苷的α-羟基糖，除常见的D-葡萄糖、L-鼠李糖外还有L-夫糖、D-鸡纳糖、D-弩箭子糖、D-6-去氧阿洛糖等6-去氧糖（A错）和L-黄花夹竹桃糖、D-洋地黄糖等6-去氧糖甲醚（C错）。②α-去氧糖强心苷中普遍具有α-去氧糖，如D-洋地黄毒糖等2，6-二去氧糖；L-夹竹桃糖、D-加拿大麻糖、D-迪吉糖和D-沙门糖等2，6-二去氧糖甲醚。α-氨基糖（D错）不属于强心苷中糖的种类。